治疗中风中经络气虚血滞、脉络瘀阻证，应首选
A. 天麻钩藤汤
B. 补阳还五汤
C. 桃红四物汤
D. 镇肝熄风汤
E. 大活络丹与二陈汤

正确答案：B。补阳还五汤

解析：补阳还五汤重用生黄芪补益元气为君，当归尾活血通络而不伤血，赤芍、川芎、 桃仁、红花协同当归尾以活血祛瘀；地龙通经活络，力专善走，周行全身，全方共奏补气，活血，通络之功，故最宜治疗气虚血滞、脉络瘀阻证（B对）。天麻钩藤饮功能平肝息风，清热活血，补益肝肾，主治肝阳偏亢，肝风上扰证（A错）。桃红四物汤功能活血化瘀，主治血虚兼血瘀证（C错）。镇肝息风汤功能镇肝息风，滋阴潜阳，主治类中风（D错）。大活络丹功能祛风除湿，化痰通络，活血止痛，主治风寒湿痹。二陈汤功能燥湿化痰，理气和中，主治湿痰证（E错）。